关于舌下神经及核的描述何者错误
A. 属特殊内脏运动性质
B. 其纤维在锥体和橄榄体间出脑
C. 损伤右侧中央前回下部,伸舌时舌尖偏向左侧
D. 右侧舌下神经受损,伸舌偏向右侧
E. 损伤左内囊后肢,右侧舌下神经核的支配不受影响

正确答案：A。属特殊内脏运动性质

解析：舌下神经含一般躯体运动纤维，属一般躯体运动性质（A错，为本题正确答案）。一侧舌下神经仅起自对侧延髓舌下神经核，经过内囊膝部后，在锥体和橄榄体间出脑（B对），经舌下神经管出颅，分布于同侧舌肌。右侧舌下神经受损时，右侧舌肌瘫痪，伸舌偏向右侧（D对）。因舌下神经核只受对侧皮质核束支配，损伤右侧中央前回下部，即右侧皮质核束受损，会导致左侧舌肌瘫痪，伸舌时舌尖偏向左侧（C对）。皮质核束经过内囊的部位为内囊膝部，损伤左内囊后肢对皮质核束没有影响，因而右侧舌下神经核的支配不受影响（E对）。